蒲黄的药用部位是
A. 块根
B. 全草
C. 花粉
D. 果实
E. 种子

正确答案：C。花粉

解析：蒲黄为香蒲科植物水烛香蒲、东方香蒲或同属植物的干燥花粉（C对）。药用部分为块根（A错）的中药有天花粉、郁金、麦冬、地黄、何首乌等。药用部分为全草（B错）的中药有紫花地丁、金钱草、半枝莲等。药用部分为果实（D错）的中药有地肤子、五味子、木瓜、山楂等。药用部分为种子（E错）的中药有桃仁、杏仁、葶苈子等。